使用比值比反映暴露与疾病联系强度的研究为
A. 描述性研究
B. 病例对照研究
C. 队列研究
D. 流行病学实验研究
E. 分析性研究

正确答案：B。病例对照研究